射频辐射是指
A. 高频电磁场和微波
B. 高频电磁场和紫外线
C. 高频电磁场和激光
D. 微波和激光
E. 激光与X射线

正确答案：A。高频电磁场和微波

解析：本题考查射频辐射。射频辐射又被称为射频电磁场，射频电磁场是指频率在1OOkHz～300GHz的电磁辐射，也称无线电波，包括高频电磁场和微波（A对BCDE错），是电磁辐射中量子能量较小、波长较长的频段，波长范围为1mm～3km。